下列哪项不是癔症转换症状
A. 癔症性遗忘
B. 癔症性失明
C. 癔症性瘫痪
D. 癔症性失音
E. 癔症性抽搐

正确答案：A。癔症性遗忘

解析：癔症性遗忘是癔症分离症状而不是癔症转换症状（A错，为本题正确答案）。癔症是指一种以分离症状（部分或完全丧失对自我身份识别和对过去的记忆）和转换症状（在遭遇无法解决的问题和冲突时产生的不快心情，以转化成躯体症状的方式出现）为主的精神障碍，其中癔症转换症状包括癔症性失明、癔症性瘫痪、癔症性失音、癔症性抽搐（BCDE对）。